患儿，3岁。眼睑及双下肢明显水肿，少尿1周，体检：精神状态良好，眼睑水肿，双下肢呈凹陷性水肿，血压90/60mmHg，心肺正常，尿常规：蛋白（+++），红细胞0～3个/HP，血浆总蛋白45g/L，蛋白22g/L，抗“O”正常，C3补体正常，胆固醇11.2mmol/L。该患儿治疗应诊断为
A. 急性肾炎
B. 单纯性肾病
C. 肾炎性肾病
D. 急进性肾炎
E. 病毒性肾炎

正确答案：B。单纯性肾病

解析：单纯性肾病（B对）常见的临床表现有大量蛋白尿，低蛋白血症、高脂血症和眼睑及双下肢水肿。题中实验室检查：尿常规：蛋白（+++）（正常为-），红细胞0-3个/HP，血浆总蛋白45g/L（正常值为60～80g/L），白蛋白22g/L（正常值约30～40g/L），抗“O”正常，C3补体正常，胆固醇11.2mmol/L（正常值为0～5.2mmo/L），可见单纯性肾病（B对）成立。急性肾炎（A错）、急进性肾炎（D错）一般会出现C3补体升高。病毒性肾炎（E错）会出现C3补体降低，而非正常。肾炎性肾病（C错）发病年龄多在学龄期儿童，水肿一般不严重，补体C3、血压可有不同程度升高，而本题中患儿血压仅90/60mmHg。故不考虑肾炎性肾病。